对免疫细胞具有趋化和激活作用细胞因子
A. 白细胞介素
B. 干扰素
C. 肿瘤坏死因子
D. 集落刺激因子
E. 趋化因子

正确答案：E。趋化因子

解析：趋化因子，也称趋化性细胞因子，对免疫细胞具有趋化和激活作用。掌握“细胞因子及受体”知识点。